起于颞窝及颞深筋膜的深面，上提下颌骨，也参与侧方运动的是
A. 咬肌
B. 颞肌
C. 翼内肌
D. 翼外肌
E. 舌骨上肌群

正确答案：B。颞肌

解析：颞肌起于颞窝及颞深筋膜的深面，通过颧弓深面，止于喙突及下颌支前缘直至第三磨牙远中。功能：上提下颌骨，也参与侧方运动。掌握“咀嚼肌、颈部肌及口颌系统肌链”知识点。